下列有关队列研究的叙述中错误的是
A. 属于分析性研究
B. 暴露与疾病在时间上必须是前瞻性的
C. 一般需要计算人年
D. 随访期间还需要继续收集有关暴露的资料
E. 观察终点就是观察终止时间

正确答案：E。观察终点就是观察终止时间

解析：本题考查队列研究的相关内容。队列研究是将人群按是否暴露于某可疑因素及其暴露程度分为不同组，追踪其各组的结局，比较不同组之间结局频率的差异，从而判定暴露因素与结局之间有无因果关联及关联大小的一种观察性研究方法。该研究属于分析性研究（A对）。暴露与疾病在时间上必须是前瞻性的（B对）。在随访期间还需要继续收集有关暴露的资料（D对）。队列研究一般需要计算人年（C对）。观察终点是指研究对象出现了预期的结果，达到了这个观察终点，就不再对该研究对象继续随访。观察终止时间是指整个研究工作截止的时间，也即预期可以得到结果的时间（E错，为本题正确答案）。